满足患病率＝发病率×病程的条件是
A. 在相当长的时间内，发病率相当稳定
B. 在相当长的时间内，病程相当稳定
C. 在相当长的时间内，患病率相当稳定
D. 在相当长的时间内，当地人口相当稳定
E. 在相当长的时间内，发病率和病程都相当稳定

正确答案：E。在相当长的时间内，发病率和病程都相当稳定

解析：本题考查患病率公式满足条件。当某病的发病率和该病的病程在相当长时间内保持稳定（E对ABCD错）时患病率取决于两个因素，即发病率和病程。患病率、发病率和病程三者的关系是：患病率＝发病率×病程。